某男，35岁，长期胃脘隐痛，喜温喜按，面白，神疲乏力，近日伴见鼻流清涕，微热，恶风。临床诊断最可能是
A. 实中夹虚证
B. 虚中夹实证
C. 虚实并重证
D. 里实证
E. 里虚证

正确答案：B。虚中夹实证

解析：“长期胃脘隐痛，喜温喜按”说明病理变化以虚为主，“近日伴见鼻流清涕，微热，恶风”说明患者除了里虚病症外还有表实的表现，所以可以得出虚中夹实的病机（B对）。